男，76岁。左侧舌前部的癌，其颈淋巴结转移的常见部位为
A. 对侧下颌下淋巴结
B. 左侧颈深上淋巴结
C. 左侧颈深中淋巴结
D. 左侧下颌下及颈深淋巴结上、中群转移
E. 左侧下颌下及颈浅淋巴结上、中群转移

正确答案：D。左侧下颌下及颈深淋巴结上、中群转移

解析：因舌体具有丰富的淋巴管和血液循环，加以舌的机械运动频繁，这些都是促使舌癌转移的因素。舌癌的颈淋巴结转移常在一侧，如发生于舌背或越过舌体中线的舌癌可以向对侧颈淋巴结转移；位于舌前部的癌多向下颌下及颈深淋巴结上、中群转移；舌尖部癌可以转移至颏下或直接至颈深中群淋巴结。此外，舌癌可发生远处转移，一般多转移至肺部。掌握“鳞状细胞癌概述及舌癌、牙龈癌”知识点。